疼痛较重，舌苔薄黄，脉弦数。其诊断是
A. 接触性皮炎
B. 药物性皮炎
C. 蛇串疮
D. 热疮
E. 湿疮

正确答案：C。蛇串疮

解析：该患者表现符合蛇串疮的特点：皮肤上出现成簇水疱，呈带状分布，痛如火燎的急性疱疹性皮肤病，皮疹多发生于身体一侧，不超过正中线，皮损好发于腰胁、胸部、头面、颈部（C对）。接触性皮炎常有过敏原接触史，且皮损多见边界清晰的红斑（A错）。药物性皮炎常有药物接触史，皮损排列不成带状（B错）。热疮是泛指夏暑季发生的浅表小疮，特指热病之后出于口角及颜面的疱疹性皮肤病。又名热气疮，燎疱（D错）。湿疮是一种过敏性炎症性皮肤病，特点是皮损对称分布（E错）。